糖尿病患者应慎用的药物是
A. 甘露醇
B. 氢氯噻嗪
C. 呋塞米
D. 阿米洛利
E. 螺内酯

正确答案：B。氢氯噻嗪